下列有关急性胰腺炎的各项检查中，最早出现异常的是
A. 血清脂肪酶
B. 血清正铁血白蛋白
C. 血淀粉酶
D. 尿淀粉酶
E. 血清乳酸脱氢酶

正确答案：C。血淀粉酶

解析：诊断急性胰腺炎的重要标志物有血清淀粉酶、尿淀粉酶及血清脂肪酶。其中，血清淀粉酶（C对）是急性胰腺炎的各项检查中最早出现异常的指标，于起病后2~12个小时开始升高；尿淀粉酶（D错）于起病后24小时开始升高；血清脂肪酶（A错）于起病后24~72小时开始升高；血清乳酸脱氢酶（5版内科学P491）（E错）于发病后8~18小时开始升高，缺乏特异性，现已少用。腹腔内出血时红细胞破坏释放出血红素，经脂肪酸和弹力蛋白酶作用转变为正铁血红素，后者与白蛋白结合成正铁血白蛋白。血清正铁血白蛋白（B错）在重症胰腺炎起病72小时内常为阳性，是判断急性胰腺炎病情和预后的指标。